下列高血钾症的治疗原则中，哪项是错误的
A. 立即停止钾盐摄入
B. 积极防治心律失常
C. 降低血钾浓度
D. 恢复肾脏功能
E. 补充血容量

正确答案：E。补充血容量

解析：治疗高血钾症应立即停止钾盐摄入（包括药物和食物）摄入，积极治疗原发病，切断钾的来源，所以在高血钾症的治疗原则中补充血容量是错误的（E对）。高血钾症的治疗原则包括立即停止钾盐摄入（包括药物和食物）摄入，积极治疗原发病，切断钾的来源（A错）。积极防治心律失常，应用钙剂拮抗钾对心肌的抑制作用（B错）。降低血钾浓度，使K⁺暂时转人细胞内（C错）。恢复肾脏功能（D错）。